来源为硫化物类矿物黄铁矿的药材是
A. 自然铜
B. 赭石
C. 磁石
D. 滑石
E. 炉甘石

正确答案：A。自然铜

解析：本题考查的是自然铜的来源。来源为硫化物类矿物黄铁矿的药材是自然铜（A对）。自然铜：【来源】为硫化物类矿物黄铁矿族黄铁矿。主含二硫化铁（FeS₂）。赭石（B错）：【来源】为氧化物类矿物刚玉族赤铁矿。主含三氧化二铁（Fe₂O₃）。磁石（C错）为含铁氧化物类中药。滑石（D错）：【来源】为硅酸盐类矿物滑石族滑石。主要含含水硅酸镁[Mg₃（Si₄O₁₀）（OH）₂]。炉甘石（E错）：【来源】为碳酸盐类矿物方解石族菱锌矿。主含碳酸锌（ZnCO₃）。